以共价键方式与靶点结合的药物是
A. 尼群地平
B. 乙酰胆碱
C. 氮唑
D. 环磷酰胺
E. 普鲁卡因

正确答案：D。环磷酰胺

解析：本题考查药物与生物大分子相互作用的方式。环磷酰胺（D对）是烷化剂的一种，作用机制是与DNA的鸟嘌呤碱基结合形成共价键。非共价键键合是可逆的结合形式，其键合的形式有：范德华力、氢键、疏水键、静电引力、电荷转移复合物、偶极相互作用力等。离子-偶极，偶极-偶极的相互作用在羰基化合物中较常见，如乙酰胆碱（B错）和受体的作用。普鲁卡因（E错）是局麻药，其与受体的作用包括多种结合模式，如范德华力、偶极-偶极作用等。尼群地平（A错）是钙离子拮抗剂、氮唑作用机制复杂（C错），两者均不属于以共价键方式与靶点结合的药物。